居住区环境质量评价指标有
A. 容积率
B. 人均居住面积定额
C. 居住建筑密度
D. 居住区人口密度
E. 以上都是

正确答案：E。以上都是

解析：本题考查居住区环境质量评价指标。居住区环境质量评价指标有：1.容积率：是指居住区总建筑面积与建筑用地面积的比值，这个比值越小，则居住区容纳的建筑总量越少；2.居住建筑密度：是居住用地内，各类建筑的基底总面积与居住区用地面积的比率。选定居住建筑密度和人均居住面积定额后，可计算所需的人均居住建筑用地面积；3.居住区人口密度：单位居住用地上居住的人口数量，称为人口毛密度。单位住宅用地上居住的人口数量，称为人口净密度（E对ABCD错）。